肾代偿调节
A. 固定酸
B. 挥发酸
C. 两者均有
D. 两者均无
E. 无

正确答案：A。固定酸

解析：肾代偿调节固定酸（A对），具体是通过肾小管上皮细胞的排H+排氨和重吸收Na+, HC03-等来实现，以调节pH值使之相对恒定。